狗皮膏除祛风散寒外，又能
A. 散结止痛
B. 息风止痛
C. 清热止痛
D. 活血止痛
E. 接骨止痛

正确答案：D。活血止痛

解析：本题考查的是狗皮膏的功能。狗皮膏除祛风散寒外，又能活血止痛（D对）。狗皮膏【功能】祛风散寒，活血止痛。小儿咽扁颗粒【功能】清热利咽，解毒止痛（C错）。